去甲肾上腺素的药理作用是
A. 心脏兴奋，皮肤粘膜血管收缩
B. 收缩压升高，舒张压降低，脉压加大
C. 肾血管收缩，骨骼肌血管扩张
D. 心脏兴奋，支气管平滑肌松弛
E. 明显的中枢兴奋作用

正确答案：A。心脏兴奋，皮肤粘膜血管收缩